治疗老年人便秘，慎用的泻药是
A. 吗啡
B. 木糖醇
C. 乳酶生
D. 硫酸镁
E. 乳果糖

正确答案：D。硫酸镁

解析：本题考查药物的禁忌症。治疗老年人便秘，慎用的泻药是硫酸镁（D对）。对年老体弱多病的慢性便秘者，需长期规律应用泻药，最好不要间断，以维持正常排便，预防粪便嵌塞。对老年人应慎用硫酸镁。对妊娠期妇女，在调整饮食和生活习惯后仍不能解除便秘时，可用中等剂量乳果糖（E错）。如有需要刺激肠道蠕动时，尚可使用刺激性泻药或促胃肠动力药。